男性青少年常见的肾衰竭是什么引起的
A. 紫癜性肾病
B. 狼疮性肾炎
C. 急性肾炎
D. 急进性肾炎
E. 原发性肾病综合征

正确答案：A。紫癜性肾病

解析：紫癜性肾病是过敏性紫癜以坏死性小血管炎为主要病理改变的全身性疾病，累及全身多器官出现肾脏损害时的表现。男性青少年常见的肾衰竭多由紫癜性肾病（A对）引起。